急性前壁心肌梗死并发加速性室性自主律时宜选择的治疗药物为
A. 地尔硫卓（硫氮卓酮）
B. 洋地黄
C. 阿托品
D. 利多卡因
E. 胺碘酮

正确答案：C。阿托品

解析：加速性室性自主心律虽称为心动过速，但其频率并不甚快，心率一般为55～110次/分钟，比较规则，大多为60～80次/分钟。很少超过100次/分钟。（九版内科学P244）对缓慢型心律失常可用阿托品 0.5-1mg肌内或静脉注射（C对）。地尔硫䓬（硫氮䓬酮）（A错）为钙通道阻滞剂，适用于治疗室上性心动过速及后除极触发活动所致的心律失常（九版药理学P189）。洋地黄（P172）（B错）主要用于伴有快速心房颤动/心房扑动的收缩性心力衰竭。利多卡因（D错）用于前壁心肌梗死并发短阵室速，心肌梗死一旦发现室性期前收缩或室性心动过速，立即用利多卡因50～100mg静脉注射，5～10分钟重复一次，如室性心律失常反复可用胺碘酮。胺碘酮（P206）（E错）主要用于各种室上性快速性心律失常和有器质性病变的室性心律失常。急性心肌梗死频发多源性室早时应首选胺碘酮治疗。